混悬剂的物理稳定性包括
A. 混悬粒子的沉降速度
B. 混悬剂中药物的降解
C. 絮凝与反絮凝
D. 微粒的荷电与水化
E. 结晶增长与转型

正确答案：A、C、D、E。混悬粒子的沉降速度；絮凝与反絮凝；微粒的荷电与水化；结晶增长与转型

解析：本题考查混悬剂。混悬剂的物理稳定性包括：混悬粒子的沉降速度（A对）、絮凝与反絮凝（C对）、微粒的荷电与水化（D对）、结晶增长与转型（E对）。药物的降解中药物发生了化学反应，导致了药物降解，不属于物理变化（B错）。